构成四级医疗事故的情形为
A. 造成患者明显人身损害的其他后果的
B. 造成患者轻度残疾器官组织损伤导致一般功能障碍的
C. 造成患者中度残疾器官组织损伤导致严重功能障碍的
D. 造成患者死亡重度残疾的
E. 造成患者死亡的

正确答案：A。造成患者明显人身损害的其他后果的

解析：《医疗事故处理条例》总则第四条：根据对患者人身造成的损害程度，医疗事故分为四级： 一级医疗事故：造成患者死亡、重度残疾的（DE错）； 二级医疗事故：造成患者中度残疾、器官组织损伤导致严重功能障碍的（C错）；三级医疗事故：造成患者轻度残疾、器官组织损伤导致一般功能障碍的（B错）；四级医疗事故：造成患者明显人身损害的其他后果的（A对）。